男，13岁。2天来出现咽痛、发热。查体：咽充血，软腭、腭垂、咽及扁桃体表面有灰白色疱疹及浅表溃疡，周围有红晕，最可能的诊断是
A. 疱疹性咽峡炎
B. 支气管炎
C. 流行性感冒
D. 肺结核
E. 肺炎

正确答案：A。疱疹性咽峡炎

解析：男性青少年患者，2天来出现咽痛、发热。查体：咽充血，软腭、腭垂、咽及扁桃体表面有灰白色疱疹及浅表溃疡，周围有红晕，综合患者的症状、体征，最可能的诊断是疱疹性咽峡炎（A对）。软腭、腭垂、咽及扁桃体表面有灰白色疱疹及浅表溃疡，周围有红晕，可排除支气管炎（B错）、流行性感冒（C错）、肺炎（E错）。肺结核（D错）可有低热、食欲缺乏、疲乏、盗汗等结核中毒症状。